甲状旁腺叙述错误的是
A. 位于甲状腺左、右侧叶的后面
B. 甲状旁腺主要分泌甲状旁腺激素，参与机体的钙，镁的调节
C. 可包埋于甲状腺实质内
D. 分泌激素调节钙磷代谢
E. 功能亢进时导致骨质疏松

正确答案：B。甲状旁腺主要分泌甲状旁腺激素，参与机体的钙，镁的调节

解析：甲状旁腺为棕黄色、黄豆大小的扁椭圆形腺体,位于甲状腺左、右侧叶的后面（A对），共两对，对称分布，甲状旁腺亦可埋入甲状腺实质内（C对）或位于甲状腺鞘外。甲状旁腺分泌甲状旁腺素，主要作用是分泌激素调节钙磷代谢，功能亢进时导致骨质疏松（DE对B错，为本题正确答案）。